下列哪些颅骨为含气骨
A. 额骨、蝶骨、颧骨、颞骨和上颌骨
B. 筛骨、上颌骨、下颌骨、额骨和蝶骨
C. 颞骨、下颌骨、颧骨和上颌骨
D. 上颌骨、蝶骨、额骨、筛骨和颞骨
E. 犁骨、蝶骨、额骨和枕骨

正确答案：D。上颌骨、蝶骨、额骨、筛骨和颞骨

解析：有些不规则骨内有与外界相通的腔洞，称含气骨。上颌骨、额骨、蝶骨及筛骨内有含气的鼻旁窦，颞骨乳突内有含气的乳突小房，故以上均为含气骨（D对）。